含必需脂肪酸较多的食用油是
A. 牛油
B. 芝麻油
C. 猪油
D. 椰子油
E. 黄油

正确答案：B。芝麻油